关于继发性牙本质的说法错误的是
A. 其生成的时间是牙根发育完成以后
B. 埋伏牙没有继发性牙本质形成
C. 形成速率与咬合力有关
D. 形成速率较原发性低
E. 其中的牙本质小管弯曲更加不规则

正确答案：B。埋伏牙没有继发性牙本质形成

解析：牙根发育完成，牙和对（牙合）牙建立了咬合关系之后形成的牙本质为继发性牙本质。埋伏牙也有继发性牙本质形成。其在本质上是一种增龄性改变，形成的速度较慢，为原发性者较低。其形成速率与食物和牙所受到的咬合力有关，较原发性者低。继发性牙本质中牙本质小管的走行方向较原发性者有较大的变异，小管也更加不规则。掌握“牙本质”知识点。